生长因子的作用机制不包括
A. 位于细胞膜上的跨膜受体蛋白
B. 含有酪氨酸激酶活性的胞内结构域
C. 酪氨酸激酶被活化
D. 使胞内的相关蛋白质直接被磷酸化
E. 酪氨酸残基磷酸化后形成与G蛋白的结合位点

正确答案：E。酪氨酸残基磷酸化后形成与G蛋白的结合位点

解析：生长因子作用的靶细胞上存在相应受体。生长因子受体有的是位于细胞膜上的跨膜受体蛋白，有的是位于胞液中。位于膜表面的受体分子常含有酪氨酸激酶活性的胞内结构域。当生长因子与这类受体结合后，受体所包含的酪氨酸激酶被活化，使胞内的相关蛋白质直接被磷酸化。掌握“癌基因与抑癌基因以及生长因子”知识点。